男，60岁，一年来右侧上后牙痛，痛多在傍晚发生，并涉及右眶下部和颞部。患者数年前曾有头痛及流涕史。查：右上5远中（牙合）面和右上6（牙合）面深龋，叩痛（+），扪痛（+），右上7和右上4牙冠完整，叩痛（-），右上8残根。为明确诊断必须做的检查是牙髓温度测试，该患者主诉疾病最可能是
A. 深龋
B. 慢性鼻窦炎
C. 急性牙髓炎
D. 慢性牙髓炎
E. 可复性牙髓炎

正确答案：D。慢性牙髓炎

解析：本题考查慢性牙髓炎的临床表现。根据病例描述，此次的主诉牙应该为右上5和右上6，患牙疼痛1年、有深龋、轻度叩痛，表明牙髓有炎症，慢性牙髓炎的疼痛多发生在下午和晚上，因此可考虑右上5和右上6为慢性牙髓炎（D对）。深龋（A错）没有自发痛，也没有叩痛，故不考虑此诊断。慢性鼻窦炎（B错）主要表现为鼻塞、脓涕、头痛，患者此次就诊未诉这种症状，虽然数年前曾有头痛及流涕史，患者有可能有慢性鼻窦炎，但这并不是这次就诊的主诉疾病。急性牙髓炎（C错）表现为阵发性自发性剧烈的疼痛，夜间痛，放射痛，疼痛不能定位，该患者右上后牙疼痛没有此特点且疼痛已持续一年，故不考虑为急性牙髓炎。可复性牙髓炎（E错）不会有自发痛，故不考虑此诊断。